可致死胎、胎儿电解质紊乱，妊娠期妇女禁用的是
A. 氢氯噻嗪
B. 麦角新碱
C. 阿司匹林
D. 卡托普利
E. 氯苯那敏

正确答案：A。氢氯噻嗪

解析：本题考查药物不良反应。氢氯噻嗪（A对）为利尿药，可致胎儿电解质紊乱、死胎，妊娠期妇女禁用。